真武汤的组成是
A. 苍术、陈皮、厚朴、甘草
B. 茵陈、栀子、大黄
C. 猪苓、茯苓、泽泻、阿胶、滑石
D. 猪苓、茯苓、泽泻、桂枝、白术
E. 附子、生姜、白术、茯苓、白芍

正确答案：E。附子、生姜、白术、茯苓、白芍

解析：真武汤壮肾中阳，茯苓术芍附生姜，少阴腹痛有水气，悸眩润惕保安康。真武汤的功用为温阳利水，主治1.阳虚水泛证。2.太阳病发汗太过，阳虚水泛证。（E对）。